口腔扁平苔藓是由哪一种细胞介导的炎症疾病
A. NK细胞
B. B淋巴细胞
C. T淋巴细胞
D. 中性粒细胞
E. 巨噬细胞

正确答案：C。T淋巴细胞

解析：本题考查口腔扁平苔藓。口腔扁平苔藓（OLP）的发病机制尚不明确，细胞介导的局部免疫应答紊乱具有重要作用。上皮固有层内有大量淋巴细胞呈密集带状浸润是其典型病理表现。浸润的淋巴细胞以T淋巴细胞为主。一般认为OLP可能是一种由T淋巴细胞（C对）介导的免疫反应性疾病。